患儿，男，5岁。头、肩、背出汗明显，活动后加重，易感冒，神疲乏力，面色少华，四肢欠温，舌淡苔薄，脉弱。治疗应首选
A. 人参五味子汤
B. 当归六黄汤
C. 黄芪桂枝五物汤
D. 生脉散
E. 玉屏风散合牡蛎散

正确答案：E。玉屏风散合牡蛎散

解析：汗证是指小儿在安静状态下，正常环境中，全身或局部出汗过多，甚则大汗淋漓的一种病证。本病例患儿以头、肩、背出汗明显，活动后加重为主要临床表现，故诊断为汗证。根据“患儿出汗明显，活动后加重，易感冒，神疲乏力，面色少华，四肢欠温，舌淡苔薄，脉弱”，可辨证为肺气虚弱，表卫不固--阳主卫外而固密，肺主皮毛，肺卫不固，津液不藏，故汗出；头为诸阳之会，肩背属阳，故汗出以头、肩、背出汗明显；动则气耗，津液随气泄，故活动后加重；肺卫失固，腠理不密，外邪乘袭，故易感冒；气阳不足，津液亏损，故神疲乏力，面色少华，四肢欠温；舌淡苔薄，脉弱为气阳不足之象。故当治以益气固表，应首选益气固表止汗的玉屏风散合敛阴止汗、益气固表的牡蛎散（E对）。人参五味子汤（A错）功用为益气健脾，适用于久嗽脾虚，中气怯弱，面白唇白者。当归六黄汤（B错）功用为滋阴泻火，固表止汗，适用于阴虚火旺之盗汗。黄芪桂枝五物汤（C错）功用为益气温经，和血通痹，适用于汗证之营卫失和证。生脉散（D错）功用为益气养阴，适用于汗证之气阴亏虚证。